下列属于多功能酶系，可以催化数十种代谢反应，参与Ⅰ相代谢反应最主要的是
A. CYP450酶
B. 过氧化酶
C. 单胺氧化酶
D. 黄素单加氧酶
E. 多巴胺β单加氧酶

正确答案：A。CYP450酶

解析：本题考查细胞色素P450酶系。细胞色素P450（CYP450）酶（A对）是一个多功能酶系，可以催化数十种代谢反应。大多数药物都可CYP450催化而氧化，CYP450存在于肝脏及肝脏外组织的内质网中，是一组酶的总称。